尿道球腺叙述错误的是
A. 一对球形器官
B. 大小似豌豆
C. 位于盆隔内
D. 排泄管细长
E. 开口于尿道球部

正确答案：C。位于盆隔内

解析：尿道球腺为一对球形器官（A对）。大小似豌豆（B对）。位于会阴深横肌内（C错，为本题正确答案）。开口于尿道球部（E对）。